脓疱疮的主要临床表现有脓疱和脓痂，好发部位是
A. 前额、胸背部
B. 直肠及肛周
C. 头、面颊、颈及四肢等暴露部位
D. 手、足的掌面
E. 口腔及咽喉部

正确答案：C。头、面颊、颈及四肢等暴露部位

解析：本题考查脓疱疮的好发部位。脓疱疮的主要临床表现有脓疱和脓痂，好发部位是头、面颊、颈及四肢等暴露部位（C对）。脓疱疮俗称“黄水疮”，是一种常见的通过接触传染的浅表皮肤感染性疾病，以发生水疱、脓疱，易破溃结脓痂为特征，主要临床表现有脓疱和脓痂，好发部位是头、面颊、颈及四肢等暴露部位。